B细胞分化成熟的场所是
A. 骨髓
B. 淋巴结
C. 胸腺
D. 外周免疫器官
E. 脾

正确答案：A。骨髓

解析：本题考查中枢和外周免疫器官。骨髓（A对）是各类血细胞和免疫细胞发生及成熟的场所，是机体重要的中枢免疫器官。骨髓中的造血干细胞最初分化为髓样干细胞和淋巴样干细胞，后者分化为祖B细胞核祖T细胞。祖B细胞在骨髓内继续分化为成熟B细胞。